中医诊断学的三大原则是
A. 证候真假、证候错杂、脉症合参
B. 四诊合参、舍症从脉、脉症合参
C. 辨证求因、审因论治、依法处方
D. 整体审察、诸诊合参、病证结合
E. 表里出入、寒热转化、虚实转化

正确答案：D。整体审察、诸诊合参、病证结合

解析：中医诊断学的三大原则是整体审察、诸诊合参、病证结合。整体、联系的观点，是中医诊断时强调整体审察的认识论基础。“四诊合参”，是指四诊并重，诸法参用，综合考虑所收集的病情资料，有利于得出准确的诊断。病证结合指在中医学中，“病”与“证”是密切相关的不同概念。病是对疾病全过程的特点与发展变化规律所作的概括，证是对疾病当前阶段的病位、病性等所作的结论。病注重贯穿于整个疾病的基本病理变化，即从疾病发生、发展全过程纵向把脉病情；证着眼于疾病某一阶段机体反应状态的病理变化，即从横向认识（D对）。